可出现强迫蹲位的疾病是
A. 急性腹膜炎
B. 先天性发绀型心脏病
C. 心绞痛
D. 破伤风
E. 急性肺水肿

正确答案：B。先天性发绀型心脏病

解析：强迫蹲位是指患者在活动过程中，因呼吸困难和心悸而停止活动并采用蹲踞位或膝胸位以缓解症状，主要见于先天性发绀型心脏病（B对）。急性腹膜炎（A错）患者可出现强迫仰卧位。心绞痛（C错）患者可出现强迫停立位。破伤风（D错）患者可出现角弓反张位。急性肺水肿（E错）患者可出现强迫坐位。